女，35岁。因接触性出血经巴氏涂片示巴氏Ⅲ级，活检诊断为浸润性宫颈癌，临床分期Ⅱa。治疗方案是
A. 全子宫+双侧附件切除术
B. 全子宫+双侧附件切除术+盆腔淋巴结清除术
C. 次广泛性子宫+双侧附件切除术+盆腔淋巴结清除术
D. 广泛性子宫+双侧附件切除术+盆腔淋巴结清除术
E. 广泛性子宫+一侧附件切除术+盆腔淋巴结清除术

正确答案：E。广泛性子宫+一侧附件切除术+盆腔淋巴结清除术

解析：中年女性患者，因接触性出血经巴氏涂片示巴氏Ⅲ级（提示有可疑癌细胞），活检诊断为浸润性宫颈癌，临床分期ⅡA，根据症状和检查，确诊宫颈癌（ⅡA），故其治疗方案是广泛性子宫+盆腔淋巴结清除术，必要时可选择性腹主动脉旁淋巴结取样。且患者35岁（＜45岁未绝经的鳞癌患者可保留卵巢），双侧附件亦未说明有转移征象，故不需切除双侧附件（E对）。